首选链霉素的疾病是
A. 鼠疫
B. 布氏杆菌病
C. 草绿色链球菌性心内膜炎
D. 浸润性肺结核
E. 立克次体病

正确答案：A。鼠疫